抑制尿酸生成的抗痛风药物是
A. 双氯芬酸
B. 秋水仙碱
C. 苯溴马隆
D. 双醋瑞因
E. 非布司他

正确答案：E。非布司他

解析：本题考查抗痛风药。抑制尿酸生成的抗痛风药物是非布司它（E对）。抗痛风药分为：（1）抑制粒细胞浸润炎症反应药：秋水仙碱（B错）；（2）促进尿酸排泄药：苯溴马隆（C错）；（3）抑制尿酸生成药：别嘌醇、非布司它；（4）碱化尿液药：碳酸氢钠；双氯芬酸（A错）为芳基乙酸类非甾体抗炎药；双醋瑞因（D错）为慢作用抗风湿药。